男性，25岁，1年来牙龈逐渐肿大。检查发现：全口牙龈乳头及龈缘肿，上下前牙明显。龈乳头球状突起，前牙龈呈分叶状、质地坚硬，略有弹性，呈粉红色，不出血，无疼痛，龈沟加深，有菌斑，无分泌，11、21部分冠折断，已做根管治疗。采集病历重点了解的是
A. 出血史
B. 家族史
C. 癫痫史
D. 是否戴过矫正器
E. 药物过敏史

正确答案：C。癫痫史

解析：此患者主要怀疑是药物性牙龈增生，需要考虑用药史，长期服用抗癫痫药物苯妥英钠（大仑丁）、钙通道阻滞剂、免疫抑制剂等是本病发生的主要原因。癫痫患者长期服用苯妥英钠，使原来已有炎症的牙龈组织发生纤维性增生。掌握“药物性牙龈肥大”知识点。